（129～130题共用题干）男，55岁。慢性乙型肝炎病史15年，乏力、间断下肢水肿5年。腹泻4天，发热、腹胀、尿少3天。查体：全腹压痛，移动性浊音阳性。最可能的诊断为
A. 急性细菌性痢疾
B. 急性肾功能衰竭
C. 结核性腹膜炎
D. 自发性腹膜炎
E. 肝癌

正确答案：D。自发性腹膜炎

解析：患者慢性乙型肝炎病史15年（肝硬化的最常见病因），腹泻4天，发热、腹胀、尿少3天（低热、腹胀或腹水持续不减为自发性细菌性腹膜炎临床表现），查体：全腹压痛，移动性浊音阳性（出现腹水，肝硬化患者出现腹水后容易导致自发性细菌性腹膜炎）。由于该患者尚未进行细菌检查，结合该患者的病史、临床表现和查体，可初步诊断为自发性腹膜炎（D对）。急性细菌性痢疾（A错）典型的临床表现是脓血便和里急后重，可伴头痛乏力。急性肾功能衰竭（P511-P512）（B错）现称为急性肾损伤，临床病程可分为起始期（高血压、缺血、脓毒血症等）、维持期（恶心、呕吐、呼吸困难、咳嗽、意识障碍）和恢复期。结核性腹膜炎（P370）（C错）患者多有结核病史，表现为结核毒血症，腹部触诊常有揉面感，脐周可触及腹部肿块。肝癌（P416）（E错）的临床表现是肝区疼痛、肝大、黄疸、肝硬化征象、全身症状和伴癌综合症。